早产儿，胎龄31周，出生8小时开始人工喂养，生后2周出现精神萎靡、纳差、腹胀、呕吐2次，大便略稀，粪隐血试验阳性。腹部B超肠蠕动和肠壁血流减弱，腹部X片最具特征的表现是
A. 肠壁间隙增厚
B. 腹壁积液
C. 选择性肠袢扩张
D. 气腹
E. 门静脉积气征

正确答案：E。门静脉积气征

解析：早产儿，胎龄31周（NEC发病人群），出生后人工喂养，生后2周出现精神萎靡、纳差、腹胀、呕吐2次，大便略稀，粪隐血试验阳性（NEC典型表现）。腹部B超肠蠕动和肠壁血流减弱（提示肠道内出血），考虑诊断为新生儿坏死性小肠结肠炎，故腹部X片最具特征的表现是门静脉积气征（E对）。肠壁间隙增厚（A错）一般可见于肠道的急慢性炎症，以及肠道息肉、肿瘤等疾病。腹腔积液（B错）一般常见于肝硬化门静脉高压症、肿瘤、结核等疾病。选择性肠袢扩张（C错）提示肠穿孔前兆或者已经出现肠穿孔。气腹（D错）即为腹腔内存在游离气体的现象，一般是由于胃肠道穿孔所致。